抑制β-内酰胺酶，对耐药菌株有效的是
A. 磺胺类药+甲氧苄啶
B. 棒酸+阿莫西林
C. 依那普利+利尿药
D. 亚胺培南+西拉司丁
E. 氟尿嘧啶+四氢叶酸

正确答案：B。棒酸+阿莫西林

解析：本题考查药物的联合应用。棒酸+阿莫西林（B对）可抑制β内酰胺酶，对耐药菌株有效。磺胺类药+甲氧苄啶（A错）对细菌叶酸代谢呈双重阻断。甲氧苄啶与磺胺类药物合用时，两者双重阻断细菌四氢叶酸的合成而产生显著的协同抑菌效应。依那普利+利尿药（C错）既增加降压效果，又减少不良反应。亚胺培南可在肾脏中被肾肽酶破坏，制剂中加入肾肽酶抑制剂西司他丁钠，可保护亚胺培南在肾脏中不受破坏，阻断前者在肾脏的代谢，保证药物的有效性（D错）。氟尿嘧啶+四氢叶酸（E错）可增加药物与TMPS酶结合，使抗癌效果增强。